神经纤维的跨膜电位从﹢30mV变为﹣70mV的过程是
A. 极化
B. 去极化
C. 超极化
D. 反极化
E. 复极化

正确答案：E。复极化